患者，女，46岁。半年来头皮、四肢出现皮损，色鲜红，瘙痒，鳞屑增多，有筛状出血点，喜凉怕热，便干、尿黄，舌红苔黄，脉滑数。其证候是
A. 血虚肝旺
B. 火毒炽盛
C. 湿热蕴积
D. 血热
E. 风热

正确答案：D。血热

解析：白疕，因其‘肤如疹疥，色白而痒，搔起皮疹’而得名，是一种常见的易于复发的炎症性皮肤病，相当于西医的银屑病，其特点是：在红斑上有松散的银白色鳞屑，抓之有薄膜及露水珠样出血点，其临床辨证分型有血热证、湿热蕴积证、血虚风燥证和火毒炽盛证，本病例皮损特点为色鲜红，瘙痒，鱗屑增多，有筛状出血点，皮损特点与之相符，故诊断白疕，其证候是血热内盛，外感入里化热或机体蕴热偏盛或情志郁而化火，侵及血分，导致血热内盛，接触凉物可以散热，血热有所减轻，遇热血热更甚，出现喜凉怕热；热邪煎灼津液，出现便干、尿黄；舌红苔黄，脉滑数，为血热内盛之象。（D对）。血虚肝旺证和风热证不是本病的辨证分型之一（AE错）。火毒炽盛证，其证候特点为多属红皮病型或脓疱型，全身皮肤发红，或呈暗红色，甚则稍有肿胀，鳞屑不多，皮肤灼热，或密布散在小脓疱，往往伴有壮热口渴、便干溲赤、苔薄舌红绛、脉弦滑数等症状（B错）。湿热蕴积证，其证候特点为多发在腋窝、腹股沟等屈侧部位，红斑糜烂，溃后流滋，瘙痒，或掌跖部有脓疱，多阴雨季节加重，伴有胸闷纳呆、神疲乏力、下肢沉重，或带下增多色黄，苔薄黄腻、脉濡滑等症状（C错）。